患者肢体关节疼痛较重，部位固定，遇寒加剧，所属病症为
A. 行痹
B. 热痹
C. 着痹
D. 尪痹
E. 痛痹

正确答案：E。痛痹

解析：本题考查的是痛痹的症状。患者肢体关节疼痛较重，部位固定，遇寒加剧，所属病症为痛痹（E对）。痛痹【症状】肢体关节疼痛，痛势较剧，部位固定，遇寒则痛甚，得热则痛缓，关节屈伸不利，局部皮肤或有寒冷感。舌质淡，舌苔薄白，脉弦紧。行痹（A错）【症状】肢体关节、肌肉疼痛酸楚，关节屈伸不利，可涉及肢体多个关节，疼痛呈游走性，初起可见恶风、发热等表证。舌苔薄白，脉浮或浮缓。痹证首先要辨明病邪，痹痛游走不定者为行痹，属风邪偏盛；痛势较盛，痛有定处，遇寒加剧者为痛痹，属寒邪盛；关节酸痛，重着、漫肿者为着痹，属湿邪盛；关节肿胀，局部肌肤红肿，灼热疼痛者为热痹（B错）。着痹（C错）【症状】肢体关节、肌肉酸楚、重着、疼痛，肿胀散漫，关节活动不利，肌肤麻木不仁。舌质淡，舌苔白腻，脉濡缓。尪痹（D错）【症状】痹证日久不愈，肢体、关节疼痛，屈伸不利，关节肿大僵硬、变形，甚则肌肉萎缩，筋脉拘急，肘膝不伸，或以尻代踵，以背代头，伴腰膝酸软、骨蒸潮热、自汗、盗汗。舌红或淡，脉细数。